以下哪一项是影响龋病发生的因素
A. 细菌微生物
B. 牙齿拥挤
C. 食物
D. 时间因素
E. 以上因素都包括

正确答案：E。以上因素都包括

解析：影响龋病发生的因素包括：牙菌斑、食物、宿主、时间。掌握“龋病概述”知识点。